强烈提示患者左心功能衰竭的体征是
A. 心尖部第一心音增强
B. A₂亢进
C. 舒张早期奔马律
D. 开瓣音
E. 心包叩击音

正确答案：C。舒张早期奔马律

解析：舒张早期奔马律（C对）是舒张早期出现在第二心音后的附加心音，与原有的第一、第二心音组合而成的韵律酷似马奔跑时马蹄触地发出的声音。左心衰竭时，由于舒张期心室负荷过重，心肌张力降低，心室壁顺应性减退，当血液自心房快速注入心室时，可使过度充盈的心室壁产生振动，形成额外心音，即舒张早期奔马律。心尖部第一心音增强（九版诊断学P149）（A错）常见于二尖瓣狭窄，另外，在心肌收缩力增强和心动过速时，如高热、贫血、甲状腺功能亢进等均可使第一心音增强。A₂（第二心音主动脉部分）亢进（B错）主要见于主动脉压增高，如高血压、动脉粥样硬化等。开瓣音（二尖瓣开放拍击声）（D错）见于二尖瓣狭窄而瓣膜尚柔软时。由于舒张早期血液自高压力的左房迅速流入左室，导致弹性尚好的瓣叶迅速开放后又突然停止，使瓣叶振动形成开瓣音（九版诊断学P153）。心包叩击音（九版诊断学P153）（E错）见于缩窄性心包炎，在舒张早期心室快速充盈时，由于心包增厚，阻碍心室舒张以致心室在舒张过程中被迫骤然停止，导致室壁振动而产生的声音，在胸骨左缘最易闻及。